脊柱何处损伤可伤及脊髓骶段
A. 第十一胸椎
B. 第一腰椎
C. 第三腰椎
D. 第五腰椎
E. 无

正确答案：B。第一腰椎

解析：脊髓骶段约平对第 1 腰椎，因此脊柱第一腰椎（B对）损伤可伤及脊髓骶段，第十一胸椎（A错）约平对腰髓节段；第三腰椎（C错）及第五腰椎（D错）平对脊髓下方的马尾。